位于上颌骨的是
A. 关节突
B. 关节窝
C. 翼腭窝
D. 翼肌窝
E. 尖牙窝

正确答案：E。尖牙窝

解析：上颌体：前外面有眶下孔、尖牙窝，眶下孔位于眶下缘中点下方约0.5cm处，眶下孔向后、上、外方通入眶下管；后面（颞下面）有颧牙槽嵴、牙槽孔和上颌结节；上面（眶面）有眶下管；内面（鼻面）参与鼻腔外侧壁的构成，有上颌窦裂孔、向前下方的沟与蝶骨翼突和腭骨垂直部相接构成翼腭管。掌握“上颌骨解剖特点”知识点。